上消化道出血时，为寻找出血的病因，首选的检查方法是
A. 胃镜检查
B. 上消化道钡餐
C. 胃液分析
D. 大便隐血试验
E. 选择性动脉造影

正确答案：A。胃镜检查

解析：胃镜检查（A对）有助于明确出血的部位和性质，并同时可行止血治疗，且检查阳性率高，为上消化道出血的首选检查方法。上消化道急性出血期内进行上消化道钡餐（B错）检查可促使休克发生，或引发再出血，不宜施行。胃液分析（C错）主要用于溃疡病的诊断与鉴别诊断等，而非上消化道出血病因寻找的首选方法。大便隐血试验（D错）主要用于判断消化道是否存在出血，对于消化道出血原因的诊断意义不大。选择性动脉造影（P473）（E错）操作复杂、价格昂贵，临床上不将其作为上消化道出血原因的首选检查方法。